男，63岁，排便时突发剧烈胸痛，入院急查心电图示前壁、下壁心肌梗死，脉搏40次/分，2小时后复查心电图，P波规律，QRS波群正常，心房率120次/分，心室率40次/分，该患者心电传导系统中发生异常的位置为
A. 窦房结
B. 结间束
C. 房室结
D. 左束支
E. 浦肯野纤维网

正确答案：C。房室结

解析：老年男性患者，心肌梗死后出现心率失常，心电图示P波规律，QRS波群正常，心房率120次/分，心室率40次/分（心房率＞心室率），考虑诊断为三度（完全性）房室传导阻滞，此时该患者心电传导系统中发生异常的位置为房室结（C对）。